男性，35岁，因额叶肿瘤导致癫痫发作入院，就诊时颅内压增高，喷射性呕吐，则治疗的第一步应该
A. 切除肿瘤
B. 放射治疗
C. 降低血糖
D. 化学治疗
E. 降低颅内压

正确答案：E。降低颅内压

解析：颅内肿瘤多数终将导致颅内压增高而产生临床症状，因此，降低颅压在颅内肿瘤治疗中是第一步，也是最重要的。其次，切除肿瘤是降低颅内压的根本措施。掌握“颅内肿瘤”知识点。